关于Na⁺泵生理作用的描述，不正确的是
A. Na⁺泵活动使膜内外Na⁺、K⁺呈均匀分布
B. 将Na⁺移出膜外，将K⁺移入膜内
C. 建立势能储备，为某些营养物质吸收创造条件
D. 细胞外高Na⁺可维持细胞内外正常渗透压
E. 细胞内高K⁺保证许多细胞代谢反应进行

正确答案：A。Na⁺泵活动使膜内外Na⁺、K⁺呈均匀分布